直径2.8cm的肾盂单发结石，首选的治疗方法是
A. 抗感染治疗
B. 经皮肾镜碎石
C. 药物排石
D. 肾盂切开取石
E. 体外冲击波碎石

正确答案：B。经皮肾镜碎石

解析：泌尿系统结石的治疗方法主要取决于结石大小和部位。其中，肾结石的治疗原则是：直径＜0.6cm的结石，可行药物治疗；0.6cm≤直径≤2cm的结石，行体外冲击波碎石（ESWL）；＞2cm的结石，行经皮肾镜碎石取石术（PCNL）。故对于直径2.8cm的肾盂单发结石，首选的治疗方法是经皮肾镜碎石（B对）。抗感染治疗（A错）用于尿路结石合并尿路感染的患者。肾盂切开取石（D错）主要适用于肾盂输尿管处梗阻合并肾盂结石，可在取石的同时解除梗阻。